负责向社会发布突发公共卫生事件信息的法定单位是
A. 县级人民政府
B. 省级人民政府
C. 国务院卫生计生行政部门
D. 国务院新闻办公室
E. 设区的市级人民政府

正确答案：C。国务院卫生计生行政部门

解析：国家建立突发事件的信息发布制度。国务院卫生行政部门负责向社会发布突发事件的信息（C对）。